心源性脑栓塞3小时内最宜选用的药物治疗是
A. 罂粟碱
B. 低分子肝素
C. 尿激酶
D. 降纤酶
E. 阿司匹林

正确答案：C。尿激酶

解析：心源性脑栓塞在4.5小时内为静脉溶栓治疗的适应症。常用尿激酶（C对）作为溶栓剂。发病24小时以内为改善缺血脑组织的灌注，维持较高的血压是非常重要的，因此一般不用罂粟碱（A错）等扩血管类降压药（P181）。心源性脑栓塞急性期一般不推荐使用低分子肝素（B错）等抗凝治疗。降纤酶（D错）疗效尚不确切（P183）。阿司匹林（E错）等抗血小板药物在未行溶栓治疗的情况下尽早使用，但若患者有条件进行溶栓治疗，应首选溶栓治疗。